主要通过抗氧化和调血脂的综合作用，防治动脉粥样硬化的药物是
A. 洛伐他汀
B. 烟酸
C. 普罗布考
D. 考来烯胺
E. 吉非贝齐

正确答案：C。普罗布考

解析：本题考查调血脂药。主要通过抗氧化和调血脂的综合作用，防治动脉粥样硬化的药物是普罗布考（C对）。洛伐他汀（A错）通过调节血脂预防动脉粥样硬化。烟酸（B错）为广谱调血脂药。考来烯胺（D错）为胆汁酸螯合剂类调血脂药。吉非贝齐为贝特类调血脂药（E错），以上四种药物均无抗氧化作用。